缺血性卒中二级预防最基本的预防措施是
A. 降压治疗
B. 他汀治疗
C. 抗血小板治疗
D. 改变不良生活方式
E. 颈动脉内膜剥脱术

正确答案：D。改变不良生活方式